制备微囊的化学法有
A. 喷雾干燥法
B. 冷冻干燥法
C. 界面缩聚法
D. 辐射交联法
E. 空气悬浮包衣法

正确答案：C、D。界面缩聚法；辐射交联法

解析：本题考查微囊的制备方法。微囊的制备方法：（1）化学法：包括界面缩聚法（C对）、辐射交联法（D对）。（2）物理化学法：包括单凝聚法、复凝聚法、溶剂-非溶剂法。（3）物理机械法：包括喷雾干燥法（A错）、喷雾凝结法、空气悬浮法（E错）、多孔离心法、锅包衣法。冷冻干燥法（B错）是脂质体的制备方法。